下列器官中具有毛细淋巴管分布的是
A. 脑
B. 脊髓
C. 软骨
D. 肺
E. 角膜

正确答案：D。肺

解析：毛细淋巴管分布广泛，除脑（A错）、脊髓（B错）、骨髓、上皮、角膜（E错）、晶状体、牙釉质和软骨（C错）外,遍及全身各处，所以肺部（D对）是有毛细淋巴管分布的。